属于均相液体制剂的是
A. 纳米银溶胶
B. 复方硫黄洗剂
C. 鱼肝油乳剂
D. 磷酸可待因糖浆
E. 石灰搽剂

正确答案：D。磷酸可待因糖浆

解析：本题考查均相液体制剂。磷酸可待因糖浆（D对）属于均相液体制剂。溶胶剂（A错）、乳剂（C错）、洗剂（B错）、搽剂（E错）均为多相分散体系。